原发性肝癌最常见的淋巴转移部位是
A. 主动脉旁
B. 胰周
C. 腹膜后
D. 锁骨上
E. 肝门

正确答案：E。肝门

解析：原发性肝癌淋巴转移最多见于肝门（E对）。主动脉旁（A错）、胰周（B错）、腹膜后（C错）淋巴结均为次级引流淋巴结，较肝门淋巴结转移少见。锁骨上（D错）淋巴结转移多为晚期远处转移征象。